内囊损伤后表现症状之一是
A. 对侧偏瘫
B. 对侧眼全盲
C. 对侧耳聋
D. 大、小便失禁
E. 对侧嗅觉丧失、同侧眼全盲

正确答案：A。对侧偏瘫

解析：一侧内囊损伤后，①皮质脊髓束、皮质核束损伤，因一侧的皮质脊髓束、皮质核束支配对侧躯干肢体骨骼肌及眼裂以下面肌运动，故出现对侧偏瘫（A对）；②视辐射损伤，因一侧视辐射传导的是同侧鼻侧半和对侧颞侧半视野，故出现对侧偏盲（BE错）。听觉冲动是双侧传导的，一侧听辐射损伤后双耳的听觉冲动仍可通过对侧听辐射传递到大脑的听觉中枢，因而不会出现对侧耳聋（C错）。